拥有耳毒性和肾毒性等不良反应的抗生素是
A. 林可霉素
B. 红霉素
C. 青霉素
D. 链霉素
E. 四环素

正确答案：D。链霉素

解析：氨基糖苷类抗生素代表药为链霉素，其不良反应有耳毒性、肾毒性、神经肌肉麻痹和过敏反应等。掌握“红霉素及林可霉素”知识点。